Wilcoxon两样本比较的秩和检验编秩时，若遇到两组中有相同数值，应
A. 不计秩次
B. 依次序编秩
C. 取其平均秩次
D. 以平均秩次的整数为秩
E. 不计秩次，样本含量相应减去1

正确答案：C。取其平均秩次